女，28岁。右中指末节红肿8天，疼痛剧烈，掌侧肿胀明显，予切开引流，患指应采用的正确切开是
A. 关节皱折处切开
B. 掌侧横行切开
C. 甲根处切开
D. 背侧切开
E. 侧面纵行切开

正确答案：E。侧面纵行切开

解析：患者右中指末节红肿剧痛，掌侧肿胀明显应诊断为脓性指头炎（为手指末节掌面的皮下化脓性细菌感染）。患指剧烈疼痛、肿胀明显，应当及时切开引流，以免指骨受压坏死和发生骨髓炎。手术时选用末节指侧面作纵形切口（E对BCD错），切口远侧不超过甲沟的1/2，近侧不超过指节横纹（A错），于关节皱折处切开、横行切开和背侧切开会形成瘢痕，影响手指功能。